对肝外胆道的描述何者错误
A. 左、右肝管汇合成肝总管
B. 胆囊管参与围成胆囊三角
C. 胆总管位于肝固有动脉的左侧
D. 胆总管末端与胰管汇合成肝胰壶腹
E. 胆囊颈内有螺旋襞

正确答案：C。胆总管位于肝固有动脉的左侧

解析：左右肝管汇在肝门后合成肝总管(A对)，胆囊管与肝总管和肝脏面围成胆囊三角(B对)，胆总管位于肝固有动脉的右侧(C错，为本题正确答案)，胆总管末端与胰管汇合形成肝胰壶腹(D对)，胆囊颈和胆囊管内有螺旋襞(E对)。